女性，28岁，风心病10年，心房颤动史3年，长期服用地高辛治疗，停经3个月，诊为早孕，1周来恶心、呕吐、纳差就诊，体检：心脏增大，心率70次/分，律不齐，心尖部第一心音减弱，可闻及3/6级收缩期杂音，向左腋下传导并可及舒张期杂音，胸骨左缘2~4肋间2/6级收缩期杂音，P₂亢进，心电图示心房纤颤、室性早搏。本例心脏瓣膜病应诊断为
A. 二尖瓣关闭不全伴相对性二尖瓣狭窄
B. 二尖瓣狭窄兼关闭不全伴肺动脉高压
C. 二尖瓣狭窄伴肺动脉高压
D. 二尖瓣狭窄伴主动脉瓣狭窄
E. 二尖瓣狭窄伴二尖瓣关闭不全

正确答案：B。二尖瓣狭窄兼关闭不全伴肺动脉高压

解析：育龄期妊娠女性，既往有风心病病史、心房颤动史，长期服用地高辛（洋地黄常用制剂）治疗，1周来恶心、呕吐、纳差就诊（洋地黄中毒的胃肠道反应），体检：心脏增大，心率70次/分，律不齐，心尖部第一心音减弱，可闻及3/6级收缩期杂音，向左腋下传导（提示二尖瓣关闭不全）并可及舒张期杂音（提示二尖瓣狭窄），胸骨左缘2～4肋间2/6级收缩期杂音（提示肺动脉瓣狭窄），P₂亢进（提示肺动脉压力增高），心电图示心房纤颤、室性早搏（洋地黄中毒的特征性表现）。综合以上体征和临床表现，该患者因诊断为二尖瓣狭窄兼关闭不全伴肺动脉高压（B对）。